小儿T细胞分泌IL-4达成人水平的年龄是
A. 1岁
B. 2岁
C. 3岁
D. 4岁
E. 5岁

正确答案：C。3岁

解析：机体发生免疫应答过程中可产生多种细胞因子。新生儿时T细胞功能差于成人，IFN～r产量为成人的l/8～1/10，IL～4产量为成人的l/3，因此T细胞免疫应答向Th2偏移。约在3岁以后IL～4才达到成人水平（C对）。